吉兰一巴雷综合征的脑脊液蛋白-细胞分离是指
A. 蛋白含量正常，细胞数目正常
B. 蛋白含量增高，细胞数目正常
C. 蛋白含量增高，细胞数目降低
D. 蛋白含量降低，细胞数目增高
E. 蛋白含量正常，细胞数目增高

正确答案：B。蛋白含量增高，细胞数目正常

解析：脑脊液蛋白-细胞分离是GBS（吉兰－巴雷综合征）的特征之一，多数患者在发病数天内蛋白含量正常，2～4周内蛋白不同程度升高，但较少超过1.0g/L；糖和氯化物正常；白细胞计数一般<10x10⁶/L（B对）。